高血钾引起酸碱失衡的特点是
A. 血浆pH下降，血浆H+升高，细胞内H+升高，尿液H+升高
B. 血浆pH下降，血浆H+升高，细胞内H+下降，尿液H+下降
C. 血浆pH升高，血浆H+下降，细胞内H+下降，尿液H+下降
D. 血浆pH升高，血浆H+下降，细胞内H+升高，尿液H+升高
E. 血浆pH下降，血浆H+升高，细胞内H+升高，尿液H+下降

正确答案：B。血浆pH下降，血浆H+升高，细胞内H+下降，尿液H+下降

解析：高K+血症引起H+从细胞内溢出，造成细胞内H+下降，血浆H+升高，血浆pH下降。由于细胞内H+下降，故细胞内呈碱中毒远曲小管由于小管上皮泌H碱少，引起尿液H+下降，所以高血钾引起酸碱失衡的特点是血浆pH下降，血浆H+升高，细胞内H+下降，尿液H+下降（B对）。